患者，29岁。近3个月来反复出现腹痛、腹泻，大便每日1～3次，无黏液脓血。查体：右下腹压痛，无反跳痛及肌紧张，肛周见瘘管。胃肠钡餐：回盲部线样征。下列诊断可能性最大的是
A. 肠结核
B. 克罗恩病
C. 小肠淋巴瘤
D. 溃疡性结肠炎
E. 阿米巴性肠病

正确答案：B。克罗恩病

解析：克罗恩病最常累及回肠末段与邻近右侧结肠。临床上表现为腹痛（多位于右下腹或脐周）、腹泻（粪便多为糊状，无黏液脓血）、腹部包块、瘘管形成、肛门直肠周围病变，以及发热、消痩、贫血等全身症状，X线钡餐检查示病变呈节段性，可见黏膜粗乱，纵行溃疡，鹅卵石征及“线样征”等，由此可见该患者最可能的诊断为克罗恩病。掌握“炎症性肠病（克罗恩病、溃疡性结肠炎）”知识点。